水体中ABS浓度达到多少时，就能抑制水生动物卵的孵化和浮游生物的光合作用
A. 1mg/L
B. 2mg/L
C. 3mg/L
D. 4mg/L
E. 5mg/L

正确答案：A。1mg/L

解析：本题考查能抑制水生动物卵的孵化和浮游生物的光合作用的水体中ABS浓度。水体中烷基苯磺酸钠（ABS）浓度达到1mg/L时（A对BCDE错），就能抑制水生动物卵的孵化和浮游生物的光合作用。